癌症患者生活功能指标量表（FLIC）适用对象是
A. 慢性病患者
B. 脑血管病患者
C. 心脏病患者
D. 意外伤害
E. 癌症患者

正确答案：E。癌症患者